6对鳃弓中，第1对最大称
A. 舌弓
B. 腭弓
C. 下颌弓
D. 舌咽弓
E. 上颌弓

正确答案：C。下颌弓

解析：鳃弓口腔颌面部的发育与鳃弓和咽囊有密切的关系。胚胎发育到第4周时，在胚体头部两侧出现6对柱状弓形隆起，称为鳃弓。鳃弓之间有鳃沟。6对鳃弓中，第1对最大称为下颌弓；第2对称舌弓；第3对称舌咽弓；其余3对无特别的名称。掌握“鳃弓与神经嵴”知识点。